男性，30岁，从三楼跌下左腹部跌伤，左678肋骨骨折，脾破裂肠破裂。入院时精神紧张，T38.5℃，面色苍白，肢端冰冷，脉搏细速，P110次/分，血压130/100mmHg，尿量减少。首先考虑的治疗措施为
A. 静脉输注血管收缩药物
B. 立即剖腹探查
C. 迅速补充血容量
D. 大剂量应用抗生素
E. 滴注利尿剂改善肾功能

正确答案：C。迅速补充血容量

解析：患者外伤脾破裂后出现精神紧张、面色苍白、脉搏肢端冰冷、脉搏细速、尿量减少等症状，提示出现失血性休克。失血性休克的治疗原则为迅速补充血容量（C对），恢复血压，保证脑等重要脏器的血液灌注，同时观察生命体征。若在补充血容量后血压仍不稳定，说明仍有出血，此时需立即剖腹探查（B错）。休克纠正后可进行静脉输注血管收缩药物（A错）、大剂量应用抗生素（D错）等一般性治疗措施。小剂量的血管收缩药物可强心、扩张内脏血管（作用于β₁和多巴胺受体），从而帮助恢复组织灌注。大剂量应用抗生素可预防外伤后感染。尿量减少是由于血容量减少引发的，休克纠正后多可自行好转，无需滴注利尿剂改善肾功能（E错）。